1000Hz纯音听阈声压为
A. 5μPa
B. 10μPa
C. 20μPa
D. 40μPa
E. 50μPa

正确答案：C。20μPa